小儿面呈红色，证候多属
A. 热
B. 湿
C. 燥
D. 虚
E. 实

正确答案：A。热

解析：五色主病，面呈红色多为热证（A对）。湿证多为脾虚或有湿浊，面呈黄色（B错）。燥邪为病无特殊面色（C错）。面呈白色，多为寒证、虚证（D错）。邪气盛则实，包括风、寒、暑、湿、燥、火等外邪侵入人体及痰、饮、水、湿、瘀血等有形病理产物停留于体内，故实证根据不同病邪，面色可表现为不同颜色。（E错）。